合成甘油三酯所需的脂肪酸及3-磷酸甘油的原料主要是
A. 葡萄糖代谢提供
B. 脂肪分解提供
C. 肝脏提供好
D. 新陈代谢提供
E. 小肠提供

正确答案：A。葡萄糖代谢提供

解析：合成甘油三酯所需的脂肪酸及3-磷酸甘油主要由葡萄糖代谢提供。人和动物即使完全不摄入脂肪，亦可由糖大量转变而来。掌握“脂质功能，消化吸收，及合成”知识点。